目前治疗系统性红斑狼疮的主要为
A. 非甾体抗炎药
B. 磷酸氯喹
C. 雷公藤多甙
D. 环磷酰胺
E. 泼尼松

正确答案：E。泼尼松

解析：系统性红斑狼疮是一种有多系统损害的慢性自身免疫性疾病，其治疗应首选以具有强大抗炎及免疫作用为主的糖皮质激素，目前临床上系统性红斑狼疮治疗多用泼尼松（E对），其可降低机体自身免疫反应程度，减轻病变损伤。非甾体抗炎药（A错）主要用于系统性红斑狼疮引起发热和关节痛等症状的治疗，属于对症治疗。环磷酰胺（D错）等免疫抑制剂多用于患者存在重要脏器急性进行性损伤时，多联合糖皮质激素冲击治疗，但其不良反应较多，非目前临床上治疗系统性红斑狼疮的主药。磷酸氯喹（B错）、雷公藤多甙（C错）有抗炎、抑制免疫的作用，对系统性红斑狼疮有一定疗效。